根据《关于禁止商业贿赂行为的暂行规定》，属于商业贿赂的行为有
A. 经营者为销售商品，假借宣传费名义，给付对方单位或者个人财物
B. 经营者为销售商品，假借科研费名义，给付对方单位或个人财物
C. 经营者为销售商品，假借劳务费名义，给付对方单位或个人财物
D. 经营者为销售商品，给对方单位或者个人提供国内旅游
E. 经营者为销售商品，给予为其提供服务的中间人劳务报酬

正确答案：A、B、C、D。经营者为销售商品，假借宣传费名义，给付对方单位或者个人财物；经营者为销售商品，假借科研费名义，给付对方单位或个人财物；经营者为销售商品，假借劳务费名义，给付对方单位或个人财物；经营者为销售商品，给对方单位或者个人提供国内旅游

解析：本题考查商业贿赂行为。根据《关于禁止商业贿赂行为的暂行规定》，属于商业贿赂的行为有经营者为销售商品，假借宣传费名义，给付对方单位或者个人财物（A对）；经营者为销售商品，假借科研费名义，给付对方单位或个人财物（B对）；经营者为销售商品，假借劳务费名义，给付对方单位或个人财物（C对）；经营者为销售商品，给对方单位或者个人提供国内旅游（D对）。《关于禁止商业贿赂行为的暂行规定》第二条：经营者不得违反《反不正当竞争法》第八条规定，采用商业贿赂手段销售或者购买商品。本规定所称商业贿赂，是指经营者为销售或者购买商品而采用财物或者其他手段贿赂对方单位或者个人的行为。前款所称财物，是指现金和实物，包括经营者为销售或者购买商品，假借促销费、宣传费、赞助费、科研费、劳务费、咨询费、佣金等名义，或者以报销各种费用等方式，给付对方单位或者个人的财物。第二款所称其他手段，是指提供国内外各种名义的旅游、考察等给付财物以外的其他利益的手段。经营者在交易活动中，可以以明示方式向交易相对方支付折扣，或者向中间人支付佣金（E错）。经营者向交易相对方支付折扣、向中间人支付佣金的，应当如实入账。接受折扣、佣金的经营者也应当如实入账。